引起沙门菌食物中毒的主要食物是
A. 蔬菜、水果
B. 豆类及制品
C. 谷类
D. 植物油类
E. 肉类、奶类及其制品

正确答案：E。肉类、奶类及其制品